女性，24岁，临床诊断糖尿病Ⅰ型，给予胰岛素治疗，病人经常于清晨3～4点出现手抖，大汗，饥饿感，空腹血糖11mmol/L，尿糖++++，尿酮体++++，夜间尿糖阴性，应采取的措施是
A. 减少晚餐的热量
B. 增加睡前中效胰岛素的用量
C. 加用双胍类药物
D. 减少睡前胰岛素用量
E. 后夜加餐

正确答案：D。减少睡前胰岛素用量

解析：患者诊断为糖尿病Ⅰ型，给予胰岛素治疗后，夜间出现低血糖反应（手抖、大汗、饥饿感），夜间尿糖阴性，空腹血糖（控制目标值为3.9～7.2mmol/L）及尿糖均升高。患者夜间发生低血糖，引起体内胰岛素拮抗激素分泌增加，继而导致反跳性空腹血糖升高即Somogyi效应，因此对于本例患者应采取的措施为减少睡前胰岛素用量（D对），防止夜间低血糖的发生。减少晚餐热量（A错）、增加睡前中效胰岛素用量（B错）、加用双胍类药物（C错）均会加重低血糖反应，甚至导致严重脑功能障碍。对于本例最简单实用的方法为减少睡前胰岛素用量，无后夜加餐（E错）必要。